牙髓组织是一种特殊的结缔组织，下列哪一点并非其特点
A. 周围被坚硬的牙本质包围
B. 一旦发生炎症，髓腔内压力增高
C. 血液循环丰富有较好的侧支循环
D. 具有可以形成硬组织的成牙本质细胞
E. 受到刺激时可形成修复性牙本质

正确答案：C。血液循环丰富有较好的侧支循环

解析：本题考查牙髓组织的特点。牙髓中血管通过狭窄的根尖孔位于不可让性的髓腔内，不易形成侧支循环（C错，为本题的正确答案），牙髓轻微的感染尚可恢复健康，牙髓发生较重的炎症时，牙髓易坏死。牙髓组织周围被坚硬的牙本质包围（A对），一旦发生炎症，髓腔内压力增高（B对），无法相应扩张以减轻压力，牙髓神经末梢受压而产生剧烈疼痛。牙髓组织包含可形成牙本质的成牙本质细胞（D对）。在牙发育完成，即根尖孔形成以后，随着年龄的增长和牙受到外界的生理或病理性刺激，可形成继发牙本质和（或）修复性牙本质（E对）。